牙周袋根据其形态以及袋底位置与相邻组织的关系分类中，牙槽骨水平吸收多形成
A. 骨上袋
B. 骨下袋
C. 单面袋
D. 复合袋
E. 复杂袋

正确答案：A。骨上袋

解析：牙周袋根据其形态以及袋底位置与相邻组织的关系，可分为骨上袋和骨下袋。牙槽骨水平吸收多形成骨上袋；牙槽骨垂直吸收多形成骨下袋。掌握“牙周疾病检查”知识点。